47岁男性。上颌前牙固定修复3年，现出现松动，咬合疼痛。口腔检查：左上2缺失，左上123烤瓷固定桥修复，左上13为烤瓷全冠固位体，边缘均不密合。左上1远中和左上3的近中邻面可探及深龋，左上3叩诊（++），牙龈红肿，无牙周袋。余牙健康，咬合正常。治疗前最需做的辅助检查是基牙的X线检查。原固定修复体松动原因是原固定修复体边缘不密合。拆除不良修复体后应先做左上3根管治疗。若左上13经正确的牙体治疗后最佳修复方法是
A. 烤瓷全冠固定桥修复
B. 可摘义齿修复
C. 铸造金属固定桥修复
D. 全黏膜支持式可摘义齿修复
E. 以3/4冠做固位体固定义齿修复

正确答案：A。烤瓷全冠固定桥修复

解析：本题考查牙列缺损的固定修复。左上13经正确的牙体治疗后最佳修复方法是烤瓷全冠固定桥修复（A对）。前牙修复最注重美观，后牙修复最注重咀嚼功能的恢复，因此铸造金属固定桥修复（C错）适用于后牙牙列缺损的固定修复。可摘义齿修复（B错）是牙列缺损患者常用的活动修复方法。全黏膜支持式可摘义齿修复（D错）适用于牙列缺失的患者。